慢性根尖周囊肿的诊断主要依靠
A. 牙髓电活力检查
B. 温度试验
C. 咬诊和叩诊
D. 探诊和扪诊
E. X线检查

正确答案：E。X线检查

解析：不同类型的慢性根尖周炎X线片表现特点不同：①慢性根尖周肉芽肿为围绕患牙根尖部的圆形或椭圆形的透射区，边界清楚。②慢性根尖周脓肿为根尖部不规则，边界比较模糊的透射区，周围的骨质也较疏松。③根尖周囊肿为根尖周圆形透射区，有阻射的白线围绕。④X线检查见围绕患牙根尖部的透射区是诊断慢性根尖周炎的关键依据。掌握“慢性根尖周炎”知识点。